下列各项中，不属于心力衰竭中医证型的是
A. 气阴亏虚
B. 心肾阳虚
C. 气虚血瘀
D. 阳虚水泛
E. 痰瘀互结

正确答案：E。痰瘀互结

解析：气阴亏虚，心脉失于濡养，则发生心力衰竭（A对）。心肾阳虚，心血失于温养，寒凝血瘀而发为心力衰竭（B对）。气虚血瘀，心脉痹阻，气血运行不畅而发为心力衰竭（C对）。阳虚水泛，心血失于温养，寒凝血瘀而发为心力衰竭（D对）。痰饮阻肺不属于心力衰竭的中医证型（E错，为本题正确答案）。